治疗蛔虫引起蛔厥腹痛呕吐，肺虚久咳，宜首选
A. 槟榔
B. 花椒
C. 乌梅
D. 使君子
E. 苦楝皮

正确答案：C。乌梅

解析：蛔虫引起蛔厥腹痛呕吐，肺虚久咳，治宜安蛔止痛止呕，敛肺止咳。乌梅具有敛肺止咳，涩肠止泻，安蛔止痛，生津止渴的功效（C对）。槟榔具有杀虫消积，行气，利水，截疟的功效，无敛肺止咳之功（A错）。花椒具有温中止痛，杀虫止痒的功效，无敛肺止咳之功（B错）。使君子具有杀虫消积的功效，无敛肺止咳之功（D错）。苦楝皮具有杀虫，疗癣的功效，无敛肺止咳之功（E错）。